有关釉梭的说法正确的一项是
A. 在牙尖及切缘部位较多见
B. 在牙颈部及窝沟处较多见
C. 是釉质形成早期，成釉细胞的末端膨大
D. 是起始于釉质表面，伸向釉质的纺锤状结构
E. 是起始于釉质牙本质界，伸向牙本质的纺锤状结构

正确答案：A。在牙尖及切缘部位较多见

解析：本题考查釉梭。有关釉梭的说法正确的一项是在牙尖及切缘部位较多见（A对）。釉梭是釉质发生早期始于釉牙本质界伸向釉质的纺锤状结构（DE错）。成牙本质细胞（C错）末端膨大的突起留在釉质内。在磨片中，牙尖及切缘部位较多见（A对B错）。